病人认为自己的思想、情感和行为均受雷达的控制，因而终日坐卧不安，这种表现是
A. 影响妄想
B. 关系妄想
C. 钟情妄想
D. 嫉妒妄想
E. 被害妄想

正确答案：A。影响妄想

解析：影响妄想（A对）又称被控制感，患者感到自己的思想、情感或意志行为受到某种外界力量的控制而身不由己。患者认为自己的思想、情感和行为均受雷达的控制，因而终日坐卧不安，为物理影响妄想。关系妄想（B错）患者认为周围环境中所发生均与自己有关。钟情妄想（C错）患者坚信自己被某异性或许多异性钟情，对方的一言一行都是对自己爱的表达。嫉妒妄想（D错）患者无中生有坚信自己的配偶对自己不忠，另有所爱。被害妄想（E错）患者坚信自己被某些人或某组织进行迫害，如投毒、跟踪、监视、诽谤等。